下列哪种情况导致的体温升高不属于过热
A. 先天性汗腺缺陷
B. 脱水热
C. 中暑
D. 严重创伤
E. 甲亢

正确答案：D。严重创伤

解析：过热属于被动性体温升高，是由于体温调节障碍、或散热障碍及产热器官功能异常等引起的，其中先天性汗腺缺陷（A对）、脱水热（B对）、中暑（C对）和甲亢（E对）引起的体温升高都属于过热，而严重创伤（D错，为本题正确答案）引起的体温升高属于致热原导致的发热。